亚急性心内膜炎最常见的致病微生物是
A. 草绿色链球菌
B. 金黄色葡萄球菌
C. EB病毒
D. 巨细胞病毒
E. 柯萨奇B组病毒

正确答案：A。草绿色链球菌

解析：亚急性心内膜炎最常见的致病微生物是草绿色链球菌（A对）。金黄色葡萄球菌（B错）为急性心内膜炎最常见的致病微生物。EB病毒（C错）是传染性单核细胞增多症的病原体，此外EB病毒与鼻咽癌、儿童淋巴瘤的发生有密切相关性。巨细胞病毒（D错）引起以生殖泌尿系统，中枢神经系统和肝脏疾患为主的各系统感染。柯萨奇B组病毒（E错）是病毒性心肌炎最常见的致病微生物。